能够引起牙齿黄染的药物是
A. 青霉素
B. 链霉素
C. 四环素
D. 利福平
E. 利巴韦林

正确答案：C。四环素

解析：四环素类药物与新形成的骨骼和牙齿中沉积的钙离子结合，造成恒齿永久性棕色色素沉着（俗称牙齿黄染-四环素牙）。掌握“四环素、多西环素及米诺环素”知识点。